普萘洛尔没有下列哪项作用
A. 降低心肌耗氧量
B. 增加气道阻力
C. 抑制肾素释放
D. 抑制脂肪分解
E. 增加糖原分解

正确答案：E。增加糖原分解

解析：普萘洛尔：在糖尿病患者虽可引起血糖过低，但在非糖尿病人中则无降血糖作用。掌握“β肾上腺素受体阻断剂”知识点。